病理性双侧瞳孔缩小，可见于
A. 有机磷中毒
B. 青光眼
C. 视神经萎缩
D. 脑肿瘤
E. 脑疝

正确答案：A。有机磷中毒

解析：病理性瞳孔缩小见于有机磷中毒（A对）、虹膜炎症、药物反应等。青光眼绝对期（B错）、视神经萎缩（C错）瞳孔扩大。脑肿瘤（D错）、脑疝（E错）双侧瞳孔大小不等。